《中华人民共和国行政诉讼法》规定申请人不服复议决定的，可以在收到复议决定书之日起最长多少时间内向人民法院提起诉讼
A. 十日内
B. 十五日内
C. 六十日内
D. 三个月内
E. 六个月内

正确答案：B。十五日内

解析：本题考查行政诉讼法。根据行政诉讼法的规定，经过行政复议的案件，公民、法人或者其他组织对行政复议决定不服的，可在收到复议决定书之日起15日内（B对）向人民法院起诉；直接向人民法院提起诉讼的，应当自知道或者应当知道作出行政行为之日起6个月内（E错）提出。超过起诉期限的起诉会被法院驳回。